某人红细胞与B型血的血清发生凝集，其血清与B型血的红细胞不凝集，此人的血型可能是
A. A₁型
B. B型
C. AB型
D. O型
E. A₂型

正确答案：C。AB型